宗教信仰主要通过什么来影响人们的健康
A. 生活环境
B. 劳动条件
C. 行为
D. 精神生活
E. 生活方式

正确答案：D。精神生活